蛇头疔的成脓时间
A. 3天
B. 5天
C. 7天
D. 10天
E. 14天

正确答案：D。10天

解析：蛇头疔成脓时间约10天左右，此时多阵阵啄痛不休，常影响食欲和睡眠（D对）。